男，55岁。间断少尿、腹胀1年，腹痛、低烧1周。既往肝炎肝硬化病史15年。查体：T37.5℃，P84/次，R18次/分，BP90/60mmHg。双肺呼吸音清，未闻及干湿啰音，心律齐，腹膨隆，全腹轻压痛，无反跳痛，移动性浊音阳性。腹水常规：比重1.017，蛋白28g/L，细胞总数920×10⁶/L，白细胞数800×10⁶/L，多形核细胞0.80。最可能的诊断是
A. 肝肾综合征
B. 自发性腹膜炎
C. 原发性肝癌
D. 门静脉血栓形成
E. 结核性腹膜炎

正确答案：B。自发性腹膜炎

解析：男，55岁。间断少尿、腹胀1年，腹痛、低烧1周。既往肝炎肝硬化病史15年。查体：T37.5℃（低热），P84/次，R18次/分，BP90/60mmHg（低血压）。双肺呼吸音清，未闻及干湿啰音，心律齐，腹膨隆（腹水），全腹轻压痛，无反跳痛，移动性浊音阳性。腹水常规：比重1.017，蛋白28g/L，细胞总数920×10⁶/L，白细胞数800×10⁶/L，多形核细胞0.80。根据病史、临床表现、铺助检查，最可能的诊断是自发性腹膜炎（B对）（P408）。肝肾综合征的诊断标准：（1）肝硬化合并腹水；（2）急进型血清肌酐浓度在2周内升至2倍基线值，或＞226umoL（25mL），缓进型血清肌酐＞133umoL/L（15mg/L）；（3）停利尿剂至少2天以上并经白蛋白扩容[1（kg·d），最大量100g/cd]后，血清肌酐值没有改善（＞133moL/L）；（4）排除休克；（5）目前或近期没有应用肾毒性药物或扩血管药物治疗；（6）排除肾实质性疾病，如尿蛋白＞5md，显微镜下观察血尿＞50个红细胞或超声探及肾实质性病变（A错）（八版内科学P424）。门静脉血栓形成的临床表现变化较大，当血栓缓慢形成，局限于门静脉左、右支或肝外门静脉，侧枝循环丰富，多无明显症状，常被忽略，往往首先由影像学检查发现。急性或亚急性发展时，表现为中、重度腹胀痛或突发剧烈腹痛、脾大、顽固性腹水、肠坏死、消化道出血及肝性脑病等，腹穿可抽出血性腹水（D错）（P409）。